最多见的甲状腺癌
A. 乳头状腺癌
B. 滤泡状腺癌
C. 未分化癌
D. 髓样癌
E. 转移癌

正确答案：A。乳头状腺癌

解析：甲状腺癌的主要组织学类型有乳头状癌（A）、滤泡状癌（B）、髓样癌（D）和未分化癌（C）。其中乳头状癌（A对）是甲状腺癌中最常见的类型，约占60%。转移癌（E错）指肿瘤细胞从原发部位进入淋巴管，血管或其他途径被带到它处继续生长，形成的与原发部位肿瘤相同类型的肿瘤，不属于主要的甲状腺癌类型。